在体内的维生素B₁主要以哪种形式存在
A. TMP
B. TDP
C. TPP
D. TTP
E. ATP

正确答案：C。TPP